下列哪项不是个人防护用品使用应注意的事项
A. 正确选择性能符合要求的用品
B. 充分理解使用目的和意义
C. 做好维护保养，妥善安放，便于取用
D. 建立发放和管理制度
E. 尽量节约使用，以降低生产成本

正确答案：E。尽量节约使用，以降低生产成本